临床最常见的肌瘤类型是
A. 肌壁间肌瘤
B. 黏膜下肌瘤
C. 浆膜下肌瘤
D. 游离性肌瘤
E. 阔韧带肌瘤

正确答案：A。肌壁间肌瘤

解析：肌壁间肌瘤∶肌瘤位于子宫肌壁间，周围被肌层包围，占60%～70%（A对）；黏膜下肌瘤∶肌瘤向宫腔方向生长，凸于宫腔，表面仅黏膜层覆盖，占10%～15%（B错）；浆膜下肌瘤：肌瘤向子宫浆膜生长，凸出于子宫表面，肌瘤表面仅由子宫浆膜覆盖，约占20%，肌瘤表面仅由于子宫浆膜层覆盖，当瘤体继续向浆膜面生长，仅有蒂与子宫肌壁相连，成为带蒂的浆膜下肌瘤，营养由蒂部血管供应，因血供不足，易变性、坏死，若蒂部扭转而断裂，肌瘤脱落至腹腔或者盆腔，形成游离性肌瘤，如果肌瘤位于宫体侧壁，向宫旁生长，突入阔韧带两叶之间，称为阔韧带肌瘤（CDE错）。